多发生在秋冬季
A. 致病性大肠杆菌肠炎
B. 轮状病毒性肠炎
C. 生理性腹泻
D. 细菌性痢疾
E. 金黄色葡萄球菌肠炎

正确答案：B。轮状病毒性肠炎

解析：多发生在秋、冬季的是轮状病毒性肠炎（B对），病原体为A组轮状病毒，感染呈世界性分布，在温带和亚热带地区以秋冬季为多见。致病性大肠杆菌肠炎（A错）是由于病原性大肠埃希杆菌引起的，5～6月份为发病高峰。生理性腹泻（C错）多见于婴儿，是由于其消化功能不全引起的。细菌性痢疾（P178）（D错）是由于感染志贺菌（痢疾杆菌）引起的，终年散发，在夏秋季发病率高。金黄色葡萄球菌肠炎（E错）是多继发于使用大量抗生素后，病程与症状常与菌群失调的程度有关，有时继发于慢性疾病的基础上。